女，32岁，婚后3年不孕，患者平素月经规律，妇科检查未发现异常。内分泌检查正常，造影示双侧输卵管堵塞。适宜的辅助生育是
A. 精子输卵管内移植
B. 胞浆内单精子注射
C. 植入前遗传学诊断技术
D. 体外受精与胚胎移植
E. 人工授精

正确答案：D。体外受精与胚胎移植

解析：该患者婚后3年不孕，造影示双侧输卵管堵塞，其他检查无异常，为输卵管性不孕症（临床上对输卵管性不孕症患者，在通过其他常规治疗无法妊娠，为IVF-ET的适应症）。适宜的辅助生育是体外受精-胚胎移植（D对），其是指从妇女卵巢内取出卵子，在体外与精子发生受精并培养3～5日，再将发育到卵裂期或囊胚期阶段的胚胎移植到宫腔内，使其着床发育成胎儿的全过程，俗称“试管婴儿”。精子输卵管内移植（A错）是将配子，即成熟的卵子及获能的精子，通过腹腔镜或腹部小切口直接放进输卵管壶腹部，使精子和卵子在体内正常输卵内自然受精，然后受精卵通过输卵管管壁的纤毛运动移行到子宫内着床发育；人工授精（P372）（E错）是将精子通过非性交方式注入女性生殖道内使其受孕的一种技术，适用于具备正常发育的卵泡、正常范围的活动精子数目，健全的女性生殖道结构，至少一条通畅的输卵管的不孕（育）症夫妇。以上两种辅助生殖技术均需至少一条通畅的输卵管，不适用于本例患者。胞浆内单精子注射（P373）（B错）主要用于治疗重度少、弱、畸形精子症的男性不育患者。植入前遗传学诊断技术（P373）（C错）主要用于解决有严重遗传性疾病风险和染色体异常夫妇的生育问题，可以使得产前诊断提早到胚胎期，避免了常规中孕期产前诊断可能导致引产对母体的伤害。